内侧丘系
A. 发自对侧薄束核和楔束核
B. 发自同侧薄束核和楔束核
C. 纤维主要穿过脑桥基底部
D. 止于丘脑腹后内侧核
E. 传递温、痛觉

正确答案：A。发自对侧薄束核和楔束核

解析：内侧丘系发自对侧薄束核和楔束核（A对B错）。在延髓，内侧丘系位于中线的外侧，锥体的背侧；至脑桥后，则位于基底部和被盖部之间（C错），纵穿斜方体；在中脑则移向被盖腹外侧边缘，红核的外侧，而后止于丘脑腹后外侧核（D错），传递对侧躯干和上、下肢的意识性本体感觉和精细触觉（E错）。